脂肪酸β-氧化的限速步骤是
A. β-酮脂酰CoA硫解
B. β-羟脂酰CoA脱氢
C. 脂酰CoA线粒体转运
D. β-烯脂酰CoA加水
E. 脂酰CoA脱氢

正确答案：C。脂酰CoA线粒体转运

解析：脂肪酸β-氧化是脂肪酸分解的核心过程。包括以下三步：1.脂肪酸活化为脂酰CoA；2.脂酰CoA进入线粒体：催化脂肪酸氧化的酶系存在于线粒体基质，活化的脂酰CoA必须进入线粒体才能被氧化。长链脂酰CoA不能直接透过线粒体内膜，需要肉碱协助转运。此步需要肉碱脂酰转移酶Ⅰ这一关键酶。因此脂肪酸β氧化的限速步骤是脂酰CoA进入线粒体（C对），肉碱脂酰转移酶I是脂肪酸β-氧化的关键酶；3.脂酰CoA分解产生乙酰CoA、FADH2和NADH，包括：（1）脂酰CoA脱氢生成烯脂酰CoA（E错），（2）β-烯脂酰CoA加水生成羟脂酰CoA（D错），（3）β-羟脂酰CoA再脱氢生成β-酮脂酰CoA（B错），（4）β-酮脂酰CoA硫解产生乙酰CoA（A错）。